以下哪种疾病为机体产生抗上皮基底膜抗体，致使上皮的基底层下疱形成
A. 天疱疮
B. 白斑
C. 扁平苔藓
D. 良性黏膜类天疱疮
E. 红斑

正确答案：D。良性黏膜类天疱疮

解析：良性黏膜类天疱疮为预后较好的慢性自身免疫性疾病。机体产生抗上皮基底膜抗体，致使上皮的基底层下疱形成。掌握“口腔黏膜下纤维化与天疱疮，类天疱疮”知识点。